凝血酶时间（TT）延长见于
A. 纤维蛋白原降低
B. 凝血酶原降低
C. 凝血因子Ⅲ降低
D. 凝血因子Ⅷ降低
E. 凝血因子Ⅸ降低

正确答案：A。纤维蛋白原降低

解析：凝血酶时间（TT）（九版诊断学P285）是测定在受检血浆中加入标准化凝血酶溶液，到开始出现纤维蛋白丝所需的时间，反映的是抗凝血过程，其延长可见于纤维蛋白原降低（A对）、异常纤维蛋白原血症、纤维蛋白（原）降解产物增高、血中有肝素或类肝素物质存在。凝血酶原降低（B错）影响凝血第二阶段；凝血因子Ⅲ降低（P607）（C错）影响外源性凝血过程；凝血因子Ⅷ（D错）、Ⅸ降低（E错）影响内源性凝血过程（P607）。可见凝血酶原、凝血因子Ⅲ、Ⅷ、Ⅸ降低均是影响凝血过程，而不是抗凝血过程，故凝血酶时间（TT）不会延长。